门静脉收集
A. 除肝以外的全部不成对的腹腔脏器的静脉回流
B. 腹腔成对脏器的静脉回流
C. 腹腔不成对脏器的静脉回流
D. 肝脏的静脉回流
E. 腹腔全身器的静脉回流

正确答案：A。除肝以外的全部不成对的腹腔脏器的静脉回流

解析：门静脉收集除肝以外的全部不成对的腹腔脏器的静脉回流（A对）。